直接法计算6年生存率公式中的分母是
A. 所有观察对象数
B. 所有活满6年的对象数
C. 所有6年内死亡的对象数
D. 6年内死于本病的对象数
E. 6年内死于本病及活满6年的对象数

正确答案：E。6年内死于本病及活满6年的对象数